以下有关颞浅动脉的描述中，正确的是
A. 由下颌骨髁突颈平面发出
B. 颞浅动脉为颈外动脉的另一终末支
C. 主要分支分布腮腺、颞下颌关节、颅顶部软组织
D. 在耳屏前方约1cm可触及颞浅动脉的搏动
E. 以上说法均正确

正确答案：E。以上说法均正确

解析：本题考查颈内外动脉主要分支及分布。颞浅动脉：为颈外动脉的另一终末支（B对），在下颌骨髁突颈平面发出（A对）。主要分支分布腮腺、颞下颌关节及颅顶部软组织等（C对）。在耳屏前方约1cm可触及颞浅动脉的搏动（D对）。因此选E。